两药合用，以一种药为主，另—种药为辅，辅药能提高主药疗效的配伍关系，称作
A. 相使
B. 相杀
C. 相畏
D. 相反
E. 相恶

正确答案：A。相使

解析：本题主要考察中药的配伍。单味药的应用同药与药之间的配伍关系，总结为七个方面，称为药物的“七情”。包括单行、相须、相使、相畏、相杀、相恶、相反七个方面。其中两药合用，以一种药为主，另一种药为辅，辅药能提高主药疗效的配伍关系，称作相使（A对）。相杀（B错）是指一种药物能够降低或消除另一种药物的毒性或副作用。相畏（C错）是指一种药物的毒性或副作用能被另一种药物降低或消除。相反（D错）是指两种药物同用能产生或增强毒性或副作用。相恶（E错）是指两药合用，一种药物能使另一种药物原有功效降低，甚至丧失。